温经汤《金匮要略》主治证候的病因病机是
A. 五劳虚极
B. 产后血虚受寒
C. 冲任虚损
D. 下焦蓄血
E. 冲任虚寒，瘀血阻滞

正确答案：E。冲任虚寒，瘀血阻滞

解析：该题考查温经汤的主治。温经汤功能温经散寒，养血祛瘀，主治冲任虚寒，瘀血阻滞证，其他选项多无瘀血阻滞之象（E对）。趣记：熊皮贵，无人要，冬将夏，草当浇（川芎 牡丹皮 桂枝 吴茱萸 人参 芍药 麦冬 生姜 半夏 甘草 当归 阿胶）。